科学研究中应用最广、成效最大的一种方法是
A. 观察法
B. 调查法
C. 测验法
D. 个案法
E. 实验法

正确答案：E。实验法

解析：实验法：是在控制的条件下观察、测量和记录个体行为的一种研究方法，也是科学研究中应用最广、成效最大的一种方法。掌握“医学心理学研究方法及其应用”知识点。